儿童4～5岁时龋病好发于
A. 乳磨牙的（牙合）面
B. 乳磨牙的邻面
C. 上颌乳前牙的邻面
D. 上颌乳前牙的唇面
E. 乳磨牙的颊面

正确答案：B。乳磨牙的邻面

解析：本题考查乳牙龋病的患病状况。儿童4～5岁时龋病好发于乳磨牙的邻面（B对）。乳牙列中，患龋率最高的是下颌第二乳磨牙，其次是上颌第二乳磨牙、第一乳磨牙、上颌乳前牙、下颌乳前牙。1～2岁时，主要发生于上颌乳前牙的唇面和邻面（CD错）；3～4岁时，多发的是乳磨牙（牙合）面的窝沟（A错）；4～5岁时，好发于乳磨牙的邻面。